血液循环中的白细胞包括
A. 中性粒细胞
B. 嗜酸性粒细胞
C. 嗜碱性粒细胞
D. 单核细胞
E. 淋巴细胞

正确答案：A、B、C、D、E。中性粒细胞；嗜酸性粒细胞；嗜碱性粒细胞；单核细胞；淋巴细胞

解析：本题考查白细胞。正常外周血液中常见的白细胞分类有中性粒细胞（A对）、嗜酸性粒细胞（B对）、嗜碱性粒细胞（C对）、淋巴细胞（E对）和单核细胞（D对）。